TD-Ag哪项是错误的
A. 大多数为蛋白质
B. 可诱导体液免疫和细胞免疫
C. 可刺激产生IgG型抗体
D. 有免疫记忆
E. 大多数为多糖物质

正确答案：E。大多数为多糖物质